在脑干某横断面上可见锥体束外侧出现下橄榄核，中央管敞开成为第四脑室，第四脑室底的灰质内，从外向内依次可见到舌下神经核、迷走神经背核、孤束核，疑核位于下橄榄核和第四脑室周围灰质间的网状结构内，前庭核与小脑下脚相邻，此切面可能是
A. 中脑上丘阶段切面
B. 延髓橄榄中部切面
C. 脑桥中部切面
D. 中脑下丘阶段切面
E. 无

正确答案：B。延髓橄榄中部切面

解析：延髓橄榄中部切面（B对）可见锥体束外侧出现下橄榄核，中央管敞开成为第四脑室，第四脑室底的灰质内，从外向内依次可见到舌下神经核、迷走神经背核、孤束核，疑核位于下橄榄核和第四脑室周围灰质间的网状结构内，前庭核与小脑下脚相邻；中脑上丘阶段切面（A错） 中央灰质的腹侧部有左、右动眼神经核和动眼神经副核，两核发出的纤维行向腹侧，经脚间窝出脑。红核位于被盖中央，发出纤维左右交叉形成被盖腹侧交叉后下行，组成红核脊髓束。 黑质呈位于被盖和大脑脚底之间；脑桥中部切面（C错）在此平面上，脑桥基底部 更加膨大，而菱形窝及第四脑室比上一平面缩小，构成第四脑室外侧壁的纤维束是小脑上脚 。 在被盖 部的外侧部，三叉神经脑桥核和三叉神经运动核分居三叉神经纤维的内、外侧， 三叉神经运动核的背 侧出现了三叉神经中脑核；中脑下丘阶段切面（D错）位于中脑导水管周围的是中脑导水管周围灰质（又称 中脑中央灰质），其腹侧部中线两旁有左、右滑车神经核，外侧边缘处可见三叉神经中脑核。